根据药品生产监督管理的规定，《药品生产许可证》应当载明的项目中须由药品监督管理部门核准的许可事项为
A. 企业名称
B. 企业负责人
C. 生产范围
D. 生产地址
E. 发证机关

正确答案：B、C、D。企业负责人；生产范围；生产地址